如外来化合物A的LD₅₀比B大，说明
A. A引起实验动物死亡的剂量比B大
B. A的毒性比B大
C. A的作用强度比B小
D. A的急性毒性比B小
E. A引起死亡的可能性比B小

正确答案：D。A的急性毒性比B小